连某，因患严重的躁狂抑郁障碍正在精神病专科医院住院治疗。因病情恶化，患者出现伤人毁物等行为，医院在没有其他可替代措施的情况下，对其实施了约束身体的措施，但实施后没有及时通知连某的监护人。连某的父亲作为监护人探视时，看到儿子被捆绑在病床上非常气愤。依照《精神卫生法》对患者连某实施的约束行为的性质属于
A. 治疗性措施
B. 惩罚性措施
C. 保护性医疗措施
D. 诊断性措施
E. 警告性措施

正确答案：C。保护性医疗措施

解析：《精神卫生法》规定，精神障碍患者在医疗机构内发生或者将要发生伤害自身、危害他人安全、扰乱医疗秩序的行为（连某患严重的躁狂抑郁障碍，因病情恶化，出现伤人毁物等行为），医疗机构及其医务人员在没有其他可替代措施的情况下，可以实施约束、隔离等保护性医疗措施（C对）。